患者，男性，38岁，拔除右上颌第二磨牙时牙根进入上颌窦。扩大创口后取出断根，局部形成一5mm×8mm的瘘口，其最佳处理方法是
A. 填塞明胶海绵
B. 填塞碘仿纱条
C. 暂不处理待其自行愈合
D. 行上颌窦瘘修补术
E. 应行上颌窦根治术

正确答案：D。行上颌窦瘘修补术

解析：本题考查口腔上颌窦瘘的处理方法。患者，男性，38岁，拔除右上颌第二磨牙时牙根进入上颌窦。扩大创口后取出断根，局部形成一5mm×8mm的瘘口（上颌窦瘘），其最佳处理方法是行上颌窦瘘修补术（D对）。当上颌窦已有交通时，处理方法决定于交通口的大小。如直径2mm左右小的穿孔，可按拔牙后常规处理，待其自然愈合（C错）。直径2~6mm中等大小穿孔也可按上述方法处理，如将两侧牙龈拉拢缝合，进一步固定保护血凝块，更有利于自然愈合。交通口大于7mm需行上颌窦瘘修补术，用邻位组织瓣关闭创口。可将颊侧牙槽突适当降低后，利用颊侧梯形组织瓣关闭，也可使用腭侧黏骨膜舌形瓣转移封闭创口。 填塞明胶海绵（A错）+碘仿（B错）（或碘仿纱布覆盖缝合固定），不适用于穿孔直径5mm×8mm者。上颌窦根治术（E错）适用于慢性上颌窦炎、上颌窦囊肿、上颌窦外伤以及上颌窦壁骨折塌陷等症状。